女，48岁。反复双手近端指间关节、膝关节痛伴晨僵2年，肘部伸侧可触及皮下结节，质硬无触痛。诊断首先考虑
A. 脊柱关节病
B. 系统性红斑狼疮
C. 痛风
D. 骨关节炎
E. 类风湿关节炎

正确答案：E。类风湿关节炎

解析：中年女性患者（类风湿关节炎好发人群），出现反复双手近端指间关节、膝关节痛伴晨僵（类风湿关节炎典型关节表现）2年，肘部伸侧可触及质硬无痛皮下结节（类风湿关节炎常见关节外表现），诊断首先考虑为类风湿关节炎（E对）。脊柱关节病（A错）男性较多见，主要累及脊柱和骶髂关节，极少累及手关节，亦无类风湿结节出现（P825）。系统性红斑狼疮（B错）80%患者在病程中出现皮疹，其中以鼻梁和双颧颊部呈蝶形分布的红斑最具特征性（P816），一般不会出现类风湿结节。痛风（C错）关节炎常突然发病，关节剧痛，数小时内出现红、肿、热、痛，单侧第一跖趾关节最常见，一般无晨僵。骨关节炎（D错）见于50岁以上者，主要累及膝、脊柱等负重关节，可有晨僵，但时间短，一般不超过30分钟。